正确的为
A. 远视时瞳孔缩小
B. 强光时瞳孔开大
C. 受中脑内动眼神经副核控制
D. 交感神经兴奋瞳孔括约肌,使瞳孔缩小

正确答案：C。受中脑内动眼神经副核控制

解析：在弱光下或视远物时，瞳孔开大；在强光下或看近物时，瞳孔缩小，即远视时瞳孔开大，而非缩小（A错）；强光时瞳孔缩小，而非开大（B错）。负责调节瞳孔大小之一的瞳孔括约肌的收缩受中脑内动眼神经副核控制（C对），由副交感神经支配，而非交感神经（D错）。